不属于轮状病毒特点的是
A. 为RNA病毒，含11个片段
B. 电镜下可见车轮状形态
C. 主要经粪-口途径传播
D. 可引起急性出血性结膜炎
E. 可引起婴幼儿腹泻

正确答案：D。可引起急性出血性结膜炎